某患者头痛几年近来加重，且出现呕吐及双颞侧视野偏盲，CT诊断为垂体肿瘤，请问肿瘤压迫什么结构造成视野的改变
A. 三叉神经眼神经
B. 动眼神经
C. 滑车神经
D. 外展神经
E. 视交叉

正确答案：E。视交叉

解析：肿瘤压迫视交叉（E对）中的交叉纤维时，双眼颞侧半视野传入障碍，导致双眼视野颞侧半偏盲。三叉神经眼神经（A错）传导额顶部、眼鼻皮肤黏膜等的感觉，损伤时导致对应部位感觉障碍。动眼神经（B错）、滑车神经（C错）、外展神经（D错）均为眼球运动神经，损伤时导致眼球运动障碍。